脊髓白质中，传导深感觉的是
A. 脊髓丘脑束
B. 薄束、楔束
C. 皮质脊髓侧束
D. 皮质脊髓前束
E. 无

正确答案：B。薄束、楔束

解析：深感觉即本体感觉，在脊髓白质中由薄束、楔束（B对）传导，脊髓丘脑束（A错）从脊髓上行到丘脑，传导躯干和四肢的痛，温，触及压觉，皮质脊髓束，主要功能为支配骨骼肌对随意运动，起于大脑皮质中央前回和其他一些皮质区域，下行至延髓锥体交叉处,大部分纤维交叉至对侧，称为皮质脊髓侧束（C错），未交叉的纤维在同侧 下行为皮质脊髓前束（D错）。